流行性脑脊髓膜炎的典型表现是
A. 黏液脓血便
B. 米泔水样便
C. 酒醉貌
D. 皮肤巩膜黄染
E. 皮肤黏膜出血点

正确答案：E。皮肤黏膜出血点

解析：流行性脑脊髓膜炎的典型表现是皮肤黏膜出血点（E对）。黏液脓血便常见于细菌性痢疾等（A错）。米泔水样便常见于重症霍乱、副霍乱等（B错）。酒醉貌可见于流行性出血热的重症患者（C错）。皮肤巩膜黄染见于肝功能不全者（D错）。